革兰阴性菌脂多糖毒性部分是
A. 肽聚糖
B. 磷壁酸
C. 外膜
D. 脂质A
E. 特异性多糖

正确答案：D。脂质A

解析：脂多糖由脂质A、核心多糖和特意多糖三部分组成，即G-菌的内毒素。脂质A是内毒素的毒性和生物学活性的主要成分。掌握“细菌的大小、形态和基本结构”知识点。